维生素最主要的特点是
A. 不提供热量
B. 维持人体正常生长发育、繁殖、调节身体各种功能
C. 人体需要量很少
D. 人体不能合成或合成量很少，必须由食物供给
E. 是机体的组成成分

正确答案：D。人体不能合成或合成量很少，必须由食物供给